影响药物代谢的中西药联用药组是
A. 七厘散与红霉素
B. 冰硼散与青霉素
C. 银杏叶制剂与地高辛
D. 大活络丹与异烟肼
E. 苓桂术甘汤与心得安

正确答案：D。大活络丹与异烟肼

解析：本题考查的是中西药联用在药动学上的相互作用。影响药物代谢的中西药联用药组是大活络丹与异烟肼（D对）。中西药联用在药动学上的相互作用：中西药联用时影响药物的吸收，主要是影响药物的透过生物膜吸收和影响药物在胃肠道的稳定性。1.影响吸收：（1）影响药物透过生物膜吸收：中药中的某些成分如鞣质、药用炭、生物碱、果胶及金属离子等易与西药结合或吸附，特别是以固体形式口服的西药，可导致某些药物作用下降。含鞣质较多的中药有大黄、虎杖、五倍子、石榴皮等，因此中成药牛黄解毒片（丸）、麻仁丸、七厘散等不宜与口服的红霉素（A错）、士的宁、利福平等同用，因为鞣质具有吸附作用，使这些西药透过生物膜的吸收量减少。（2）影响药物在胃肠道的稳定：药物之间通过直接改变胃肠道的内环境，比如酸碱度、胃肠蠕动和排空速率等，间接引起药物吸收情况改变。2.影响分布：药物分布是指药物吸收后随血液循环分布到各组织间液和细胞内液的过程，与血浆蛋白结合率、血-脑屏障、胎盘屏障密切相关。某些中西药联用相互作用后，血药浓度有所变化，影响药物与血浆蛋白组织结合。银杏叶与地高辛（C错）合用可促进主动脉内皮细胞内Ca²⁺水平升高，使地高辛的游离血药浓度明显升高，易造成中毒，因此，临床上两者联合使用时应适当降低地高辛剂量，并进行血药浓度的监测。3.影响代谢：中西成药配伍时会影响药酶的活性，从而影响药物在体内的代谢。（1）酶促反应：中药酒剂、酊剂中含有一定浓度的乙醇，乙醇是常见的酶促剂，它能使肝药酶活性增强，在与苯巴比妥、苯妥英钠、安乃近、利福平、二甲双胍、胰岛素等药酶诱导剂合用时，使上述药物在体内代谢加速，半衰期缩短，药效下降；当与三环类抗抑郁药盐酸氯米帕明、丙米嗪、阿米替林及多塞平等配伍使用时，由于肝药酶的诱导作用，使代谢产物增加，从而增加三环类抗抑郁药物的不良反应。（2）酶抑反应：中西药合用时发生酶抑反应也会影响药物在体内代谢，使药效降低或毒副作用增加。单胺氧化酶抑制药呋喃唑酮、异烟肼、丙卡巴肼、司来吉兰等通过抑制体内单胺氧化酶的活性，使单胺氧化酶类神经递质如去甲肾上腺素、多巴胺、5-羟色胺等神经递质不被破坏，而贮存于神经末梢中。此时若口服含有麻黄碱成分的中成药如大活络丸、千柏鼻炎片、蛤蚧定喘丸、通宣理肺丸等，所含麻黄碱可随血液循环至全身组织，促进单胺类神经递质的大量释放，引起头痛、恶心、呼吸困难、心律失常、运动失调及心肌梗死等不良反应，严重时可出现高血压危象和脑出血，因此，临床上应避免联用。4.影响排泄：肾小管内尿液的酸碱度对药物的解离有明显影响。一些中药及其制剂能酸化或碱化肾小管内尿液，从而影响西药的解离，使其重吸收增加或减少，导致排泄较慢或较快。（1）增加排泄：碱性药物由于与酸性药物发生相互作用，可大大加快药物排泄速度，导致药效降低，甚至失去治疗作用。冰硼散可使尿液碱化，增加青霉素（B错）与磺胺类药物的排泄速度，降低药物有效浓度，抗菌作用明显降低。（2）减少排泄：含有机酸成分的中药，如乌梅、山茱萸、陈皮、木瓜、川芎、青皮、山楂、女贞子等与磺胺类药物、利福平、阿司匹林等酸性药物合用时，因尿液酸化，可使磺胺类药物的溶解性降低，导致尿中析出结晶，引起结晶尿或血尿，增加磺胺类药物的肾毒性；可使利福平和阿司匹林的排泄减少，加重肾脏的毒副作用。苓桂术甘汤与心得安（E错）合用可增强疗效。心得安一般指普萘洛尔，苓桂术甘汤、苓桂甘枣汤等与普萘洛尔类抗心律失常药联用，既可增强治疗作用，又能预防发作性心动过速。